患者选择非处方药时，执业药师需要特殊指导的人群有
A. 孕妇
B. 儿童
C. 老年人
D. 哺乳期妇女
E. 普通感冒患者

正确答案：A、B、C、D。孕妇；儿童；老年人；哺乳期妇女

解析：本题考查的是中药药学服务的对象。患者选择非处方药时，执业药师需要特殊指导的人群有孕妇（A对）、儿童（B对）、老年人（C对）与哺乳期妇女（D对）。中药药学服务的对象：中药药学服务的对象是广大公众，包括患者及其家属、医护人员和卫生工作者、药品消费者和健康人群。其中尤为重要的人群包括：①用药周期长的慢性病患者，需长期或终生用药者；②病情和用药复杂，患有多种疾病，需同时合并应用多种药品者；③特殊人群，如特殊体质者、肝肾功能不全者、过敏体质者、小儿、老年人、妊娠及哺乳期妇女、血液透析者，听障、视障人士以及特殊职业者如驾驶员等；④用药效果不佳，需要重新选择药品或调整用药方案、剂最、方法者；⑤用药后易出现明显的药品不良反应者；⑥应用特殊剂型、特殊给药途径者。